苔薄白，脉缓弱。治疗应首选
A. 举元煎
B. 补中益气汤
C. 固本止崩汤
D. 清热固经汤
E. 保阴煎

正确答案：C。固本止崩汤

解析：该患者月经不规律8个月，现阴道出血40天，量时多时少，为经期紊乱，月经淋漓不尽，故诊断为崩漏。患者月经不规律8个月，阴道出血40天，量时多时少为中气虚弱，冲任不固，血失统摄所致。气虚，故经色淡，质稀。脾虚，气血生化不足，脏腑功能减弱，故气短神疲，脾虚则水湿不运，泛溢肌肤，故面浮肢肿。舌淡，苔薄白，脉缓弱均为脾虚之证，故辨为脾虚证，治宜补气摄血，固冲止崩。举元煎功能益气升提，可治疗月经过多气虚证（A错）。补中益气汤功能补中益气，升阳举陷，用于治疗月经先期脾气虚证（B错）。题中辨为崩漏脾虚证，治宜补气摄血，固冲止崩，方选固本止崩汤（C对）。清热固经汤功能滋阴清热，固经止血，为崩漏血热证之实热证的选方（D错）。保阴煎功能滋阴清热凉血，可用于治疗月经过多血热证（E错）。